关于地西泮的叙述，哪项是错误的
A. 肌内注射吸收慢而不规则
B. 口服治疗量对呼吸和循环影响小
C. 较大剂量易引起全身麻醉
D. 可用于治疗癫痫持续状态
E. 其代谢产物也有生物活性

正确答案：C。较大剂量易引起全身麻醉

解析：地西泮（苯二氮（艹卓）类）较大剂量可致暂时性记忆缺失。较大剂量可轻度抑制肺泡换气功能。对心血管系统，较大剂量可降低血压、减慢心率。常用作心脏电击复律及各种内镜检查前用药。掌握“苯二氮?类”知识点。